患者，女，38岁。喉结右侧可及3cm×3cm×3cm肿物，表面光滑，质韧，无压痛，随吞咽上下移动。应首先考虑的是
A. 气瘿
B. 肉瘿
C. 血瘿
D. 石瘿
E. 瘿痈

正确答案：B。肉瘿

解析：气瘿的临床特点为女性发病率较男性略高。一般多发生在青春期，初起时无明显不适感，甲状腺呈弥漫性肿大，腺体表面较平坦，质软不痛，皮色如常，腺体随吞咽动作而上下移动，题中结块质韧，且为3cm×3cm×3cm肿物（A错）。肉瘿患者年龄多在30~40岁，以女性占多数。在结喉正中一侧或双侧有单个肿块，呈半圆形，表面光滑，质地柔韧，可随吞咽动作上下移动，按之不痛，生长缓慢，一般无明显全身症状，题中病例患者为3cm×3cm×3cm肿物为半球形，质韧，无压痛，符合肉瘿的诊断（B对）。血瘿表现为结块上血脉交结显露，题中肿物无血脉显露（C错）。石瘿的临床特点为结喉两侧结块，生长迅速，质地坚硬如石，表面凹凸不平，推之不移，并可出现吞咽受限，可伴疼痛，题中病例患者肿物质韧，无压痛，无吞咽受限（D错）。瘿痈的临床特点为结喉两侧结块，色红灼热，疼痛肿胀，甚至化脓，疼痛可牵引至耳后枕部，活动或吞咽时加重，常伴发热、头痛等症状，题中病例患者无压痛，吞咽无受限，无发热、头痛（E错）。